法作为一种特殊社会规范自身所具有的对人们的行为发生影响的性能称为
A. 卫生法的基本原则
B. 法的规范作用
C. 卫生法的立法目的
D. 法的社会作用
E. 卫生工作社会化

正确答案：B。法的规范作用

解析：法作为一种特殊社会规范自身所具有的对人们的行为发生影响的性能称为法的规范作用（B对）。